普萘洛尔没有下列哪种作用
A. 减弱心肌收缩力
B. 松弛支气管平滑肌
C. 收缩血管
D. 降低心肌耗氧量
E. 减少肾素释放

正确答案：B。松弛支气管平滑肌